《中国人民共和国药品管理法实施条例》规定，中药饮片包装必须印有或者贴有
A. 标签
B. 中药饮片标识
C. 拉丁文名称
D. 功能与主治内容
E. 禁忌内容

正确答案：A。标签

解析：本题考查中药饮片包装。中药饮片包装必须印有或贴有标签（A对）。中药饮片的标签必须注明品名、规格、产地、生产企业、产品批号、生产日期、实施批准文号管理的中药饮片还必须注明批准文号。